调摄精神属于
A. 治病求本
B. 未病先防
C. 既病防变
D. 因地制宜
E. 因时制宜

正确答案：B。未病先防

解析：七情太过，不仅可直接伤及脏腑，引起气机紊乱而发病，也可损伤人体正气，使人体的自我调节能力减弱，容易感受病邪而发病，因此调摄精神对未病先防尤为重要（B对）。既病防变（C错）包括早期诊治和防止传变，防止传变包括：阻截病传途径和先安未受邪之地。治病求本（A错）是指在治疗疾病时，必须辨析疾病的病因病机，抓住疾病的本质，并针对疾病的本质进行治疗，是整体观念与辨证论治在治疗中的体现。因地制宜（D错）根据不同的地域环境特点，来制定适宜的治疗原则，称“因地制宜”。因人制宜（E错）根据病人的年龄、性别、体质等不同特点，来制订适宜的治疗原则。